无开放创口属于
A. 挫伤
B. 擦伤
C. 咬伤
D. 刺、割伤
E. 撕裂或撕脱伤

正确答案：A。挫伤

解析：挫伤是皮下及深部组织遭受力的挤压损伤而无开放创口。伤处的小血管和淋巴管破裂，常有组织内渗血而形成瘀斑，甚至发生血肿。主要特点是局部皮肤变色、肿胀和疼痛。挫伤的治疗主要是止血、止痛、预防感染、促进血肿吸收和恢复功能。掌握“口腔颌面部软组织创伤”知识点。